乳牙和恒牙的数目及出牙时间，应为
A. 乳牙20个，出生后6个月开始萌出;恒牙32个，6～7岁开始长出
B. 乳牙16个，出生后6个月开始萌出;恒牙32个，6～7岁开始长出
C. 乳牙20个，6~7岁开始出齐;恒牙32个，10岁左右出齐
D. 乳牙20个，2岁左右出齐;恒牙30个，14岁左右出齐
E. 以上均不正确

正确答案：A。乳牙20个，出生后6个月开始萌出;恒牙32个，6～7岁开始长出

解析：乳牙共20个(B错)，出生6个月开始萌出，3岁左右出齐，恒牙14岁左右出齐(C错)，共32个(D错)，6岁左右开始长出(A对)。